女性，48岁，大便带血3个月，排便有下坠感，里急后重，直肠镜检查距肛门12cm处3cm×3cm肿块，菜花状，质脆，易出血，病理诊断为直肠腺癌。若选择手术，最佳术式为
A. 经腹会阴直肠癌根治术
B. 经腹直肠癌切除术
C. 经腹直肠癌切除、人工肛门、远端封闭手术
D. 拉下式直肠癌切除术
E. 局部切除加放疗术

正确答案：B。经腹直肠癌切除术

解析：患者癌肿距离肛门12cm，距离齿状线大于5cm，最佳术式为经腹直肠癌切除术（B对）。经腹会阴直肠癌根治术（A错）适用于腹膜反折以下的直肠癌；患者未合并肠梗阻，不宜行经腹直肠癌切除、人工肛门、远端封闭手术（C错）；拉下式直肠癌切除术（D错）保留肛门，经肛门在齿状线上切断直肠，将乙状结肠从肛门拉下，固定于肛门，适用于距离直肠7～10cm的直肠癌；局部切除加放疗术（E错）适用于早期瘤体较小的直肠癌。